女，23岁。2个月前无明显诱因出现自言自语，有时独自发笑，有时对空谩骂，感觉被人监视和跟踪，思想和行为会被某种外力控制，情绪低落，觉得被逼得走投无路，曾报警寻求保护，睡眠差，实验室检查未发现异常。该患者最可能的诊断是
A. 抑郁发作
B. 妄想性障碍
C. 双相障碍
D. 精神分裂症
E. 分裂情感性精神障碍

正确答案：D。精神分裂症

解析：该病例患者，2个月前无明显诱因出现自言自语，有时独自发笑，有时对空谩骂（幻听），感觉被人监视和跟踪，思想和行为会被某种外力控制（妄想），情绪低落（阴性症状），觉得被逼得走投无路，曾报警寻求保护，睡眠差（妄想、幻觉的支配下所表现的行为），考虑为精神分裂症（D对），妄想知觉对诊断精神分裂症具有重要价值。抑郁发作（A错）的抑郁症患者以情感低落（忧伤、苦闷、唉声叹气、暗自落泪等）为主要变现，与本例不符。妄想性障碍（B错）又称偏执状态偏执狂偏执性精神病，通常没有幻觉、情绪失控或人格解体等症状，但他们的思维与现实是割裂的。双相障碍（C错）指既有躁狂发作又有抑郁发作的一类疾病。分裂情感性精神障碍（E错）是一组精神分裂症和躁狂症两种病同时存在或交替发生，症状又同样典型，常有反复发作的精神病，此型患者同时具有精神分裂症和情感障碍的症状，特征为显著的心境症状（抑郁或躁狂）和精神分裂症症状，同时出现或至多相差几天，具反复发作特点，与本例不符。